下列关于滤泡型成釉细胞瘤叙述，正确的是
A. 细胞核呈栅栏状排列远离基底膜
B. 肿瘤形成孤立性上皮岛
C. 上皮岛周边围绕一层立方状或柱状细胞
D. 滤泡之间的肿瘤间质为疏松结缔组织
E. 以上都正确

正确答案：E。以上都正确

解析：滤泡型：肿瘤形成孤立性上皮岛，上皮岛中心部由多边形或多角形细胞组成，这些细胞之间彼此疏松连接，类似于成釉器的星网状层，上皮岛周边围绕一层立方状或柱状细胞，类似于成釉细胞或前成釉细胞，细胞核呈栅栏状排列并远离基底膜，即极性倒置。上皮岛中央的星网状区常发生囊性变，形成小囊腔，囊腔增大时周边部细胞可被压成扁平状。滤泡之间的肿瘤间质为疏松结缔组织。掌握“成釉细胞瘤”知识点。